以下关于念珠菌性口角炎说法不正确的是
A. 念珠菌性口角炎常为双侧罹患
B. 以湿白糜烂为特征
C. 年长患者的口角炎多与咬合垂直距离缩短有关
D. 儿童在寒冷的冬季常发生
E. 常并发舌炎、唇炎、阴囊炎

正确答案：E。常并发舌炎、唇炎、阴囊炎

解析：本题考查念珠菌性口角炎。以下关于念珠菌性口角炎说法不正确的是常并发舌炎、唇炎、阴囊炎（E错，为本题的正确答案）。维生素B₂缺乏症常并发舌炎、唇炎、阴囊炎。口角黏膜皮肤干裂，白色念珠菌趁虚而入以至于两侧罹患（A对）。念珠菌性口角炎是以白色念珠菌感染引起的口角炎，常以湿白糜烂为特征（B对）。年长患者咬合垂直距离变短（C对），口角区皮肤发生塌陷导致唾液由口角溢入沟内，故常呈潮湿状态，有利于真菌生长。冬季口唇干裂，儿童不注意口腔卫生，常继发念珠菌感染（D对）。